诱导支气管平滑肌强烈而持久地收缩的介质是
A. 白三烯
B. 组胺
C. 激肽类物质
D. PGD2
E. C3a

正确答案：A。白三烯